随意皮瓣
A. 没有知名血管供血，在设计皮瓣时，其长宽比例要受到一定限制的带蒂皮瓣
B. 通过肌组织发出营养支，垂直穿透深筋膜至皮下组织及皮肤的游离皮瓣
C. 营养皮肤的动脉在穿出深筋膜后与皮肤表面平行，走行于皮下组织内，并沿途发出小支以供养皮下组织及皮肤的游离皮瓣
D. 有一对知名血管供血与回流，因而只要在血管的长轴内设计皮瓣，一般可不受长宽比例的限制
E. 由动脉干上直接发出许多微细的血管支，组成丰富的网状结构，直接营养其所属的皮肤的游离皮瓣

正确答案：A。没有知名血管供血，在设计皮瓣时，其长宽比例要受到一定限制的带蒂皮瓣

解析：本题考查随意皮瓣的特点。随意皮瓣为带蒂皮瓣的一种，由于没有知名的血管供血，故在设计皮瓣时，其长宽比例要受到一定限制（A对）。通过肌组织发出营养支，垂直穿透深筋膜至皮下组织及皮肤的游离皮瓣（B错）为肌皮血管皮瓣。营养皮肤的动脉在穿出深筋膜后与皮肤表面平行，走行于皮下组织内，并沿途发出小支以供养皮下组织及皮肤的游离皮瓣（C错）为直接皮肤血管皮瓣。有一对知名血管供血与回流，因而只要在血管的长轴内设计皮瓣，一般可不受长宽比例的限制的皮瓣（D错）为轴型皮瓣。由动脉干上直接发出许多微细的血管支，组成丰富的网状结构，直接营养其所属的皮肤的游离皮瓣（E错）为动脉干网状血管皮瓣。